下列哪一结构不在颅中窝
A. 垂体窝
B. 鼓室盖
C. 内耳门
D. 三叉神经压迹
E. 颈动脉管内口

正确答案：C。内耳门

解析：内耳门属于颅后窝的结构（C错，为本题正确答案）。垂体窝（A对）、鼓室盖（B对）、三叉神经压迹（D对）、颈动脉管内口均属于颅中窝的结构（E对）。